口腔医生扪诊不能了解病变的
A. 性质、组成和结构
B. 位置、大小和轮廓
C. 波动、搏动和压痛
D. 表面特征、温度和硬度
E. 移动度及其与邻近组织的关系

正确答案：A。性质、组成和结构

解析：本题考查扪诊。口腔医生扪诊不能了解病变的性质、组成和结构（A错，为本题的正确答案）。扪诊又叫触诊，是用手指或器械在病变部位进行触摸或按压，凭检查者和被检查者的感觉对病变的硬度、范围、形状、活动度等进行判断的方法。扪诊仅是通过对病变区体征的检查对病变性质做出初步判断，确切的病变性质、组成和结构需要通过专业的辅助检查才能确定。触诊颌面部病变区或淋巴结时应注意肿大淋巴结所在的位置、大小和轮廓（B对）、移动度及其与邻近组织的关系（E对），同时还要注意是否存在波动、搏动和压痛（C对）以及淋巴结的数目、表面特征、温度和硬度（D对）。